体细胞突变可能的后果如下，除了
A. 致癌
B. 致畸
C. 遗传性疾病
D. 衰老
E. 动脉粥样硬化

正确答案：C。遗传性疾病